患者，女，56岁，血清总胆固醇和低密度脂蛋白胆固醇异常，初诊医师建议首先改变生活方式（控制饮食，增强运动）。一个月后复查血脂水平仍未达标，医师处方辛伐他汀片20mg/d治疗。服药时间应检测血生化指标，其中超过正常值上限10倍，应立即停药的指标是
A. Hcy
B. Cr
C. CK
D. BUN
E. TbiL

正确答案：C。CK

解析：本题考查辛伐他汀的使用。辛伐他汀服用注意事项：（1）以下情况慎用：大量饮酒者、肝病史患者、轻中度肾功能不全者、严重肾功能不全者（肌酐清除率<30ml/min）。（2）血清AST及ALT升高至正常值上限3倍时，须停止本品治疗。（3）对于有弥散性的肌痛、肌软弱及CK（C对）升高至大于正常值10倍以上的情况应考虑为肌病，须立即停用本品。